不属于婴儿总热量分配的是
A. 基础代谢
B. 生长发育
C. 食物特殊动力作用
D. 思维活动
E. 排泄损失

正确答案：D。思维活动

解析：婴儿总热量分配包括基础代谢（A错）、生长发育（B错）、食物特殊动力作用（C错）、排泄损失（E错）、活动消耗五个方面。不包括思维活动（D对）。